下列鉴别试验法中，属于化学方法的有
A. 显色法
B. 沉淀生成法
C. 气体生成法
D. 红外分光光度法
E. 高效液相色谱法

正确答案：A、B、C。显色法；沉淀生成法；气体生成法

解析：本题考查药物的鉴别方法。化学鉴别法包括呈色反应鉴别法（A对）、沉淀生成反应鉴别法（B对）、荧光反应鉴别法、气体生成反应鉴别法（C对）、使试剂褪色的鉴别法和测定生成物的熔点。红外分光光度法（D错）是光谱鉴别法。高效液相色谱法（E错）是色谱鉴别法。